可摘局部义齿解剖式人工牙的牙尖斜度是
A. 0°
B. 10°
C. 20°
D. 30°
E. 40°

正确答案：D。30°

解析：本题考查局部义齿人工牙及基托。解剖式牙：牙尖斜度为33°或30°（D对），又称有尖牙，与初萌出的天然牙（牙合）面相似。正中（牙合）时，上、下颌牙齿的尖凹锁结关系很好，功能较强，但侧向（牙合）力大。